在测量基础代谢率时，正确的做法是
A. 测量可在24小时内任何时候进行
B. 测量前一天晚上的饮食不受任何限制
C. 受试者应处于睡眠状态
D. 受试者无精神紧张和肌肉活动
E. 室温不限高低，但要求恒定不变

正确答案：D。受试者无精神紧张和肌肉活动

解析：测量基础代谢率有一定的要求，并非可在24小时内任何时候进行（A错）。基础代谢率的测量要求餐后12～14小时，所以前一天晚上的饮食有时间限制，并且饮食的内容也有限制（B错）。在测定基础代谢率时受试者应在清醒状态（C错）。测量基础代谢率应在无肌紧张，至少2小时以上无剧烈运动，无精神紧张的状态下进行（D对），室温要求在20～25℃的条件下进行（E错）。